下列物品中毒抢救时，禁忌洗胃的是
A. 有机磷农药
B. 浓硫酸
C. 杀鼠剂
D. 安眠药
E. 阿托品

正确答案：B。浓硫酸

解析：由于强酸强碱对胃肠段黏膜具有腐蚀作用，洗胃易导致胃穿孔的发生，故浓硫酸（B对）中毒抢救时禁忌洗胃。有机磷农药（A错）中毒及早彻底洗胃十分重要，常用2％碳酸氢钠洗胃。杀鼠剂（C错）成分未明时常用清水及时洗胃。安眠药（D错）中毒常用高锰酸钾洗胃。阿托品（E错）中毒常用鞣酸洗胃。